土壤污染引起钩端螺旋体病和炭疽病的危害途径是
A. 动物-土壤-人
B. 人-土壤-人
C. 土壤-人
D. 动物-人
E. 以上都不对

正确答案：A。动物-土壤-人

解析：本题考查土壤污染引起钩端螺旋体病和炭疽病的危害途径。动物-土壤-人的危害途径是指含有病原体的动物粪便污染土壤后，人与污染土壤接触后，病原体通过皮肤或黏膜进入人体而感染发病。土壤污染引起钩端螺旋体病和炭疽病就体现了这一危害途径（A对BCDE错）。钩端螺旋体病的传播主要是由于带菌动物（牛、羊、猪、鼠等）排出带菌尿液污染水和土壤等，人群经常接触疫水和土壤，病原体经破损皮肤侵入机体。炭疽芽孢杆菌抵抗力很强，在土壤中可存活1年以上，家畜一旦感染了炭疽病并造成土壤污染，会在该地区相当长时间内传播此病。